抗室上性和室性心律失常
A. 苯妥英钠
B. 胺碘酮
C. 维拉帕米
D. 地高辛
E. 普罗帕酮

正确答案：B。胺碘酮